葛根与升麻均有的功效是
A. 透疹
B. 解肌
C. 生津
D. 解毒
E. 疏肝

正确答案：A。透疹

解析：本题考查葛根和升麻的功效。葛根与升麻均有的功效是透疹（A对）。葛根【功效】解肌（B错）退热，透疹，生津（C错），升阳止泻。升麻【功效】发表透疹，清热解毒（D错），升举阳气。柴胡【功效】解表退热，疏肝（E错）解郁，升举阳气。